与他唑巴坦配伍，两者有良好的药动学同步性
A. 青霉素V
B. 苯唑西林
C. 替卡西林
D. 哌拉西林
E. 舒巴坦

正确答案：D。哌拉西林